患者，女，40岁。精神恍惚，心神不宁，多疑易惊，悲忧善哭，喜怒无常，舌质淡，脉弦。其证候是
A. 肝气郁结
B. 痰气郁结
C. 心神失养
D. 心脾两虚
E. 心肾阴虚

正确答案：C。心神失养

解析：郁证肝气郁结证以精神抑郁，情绪不宁，胸部满闷，胁肋胀痛，痛无定处为主症，苔薄腻，脉弦（A错）。郁证痰气郁结证以精神抑郁，胸部闷塞，胁肋胀满，咽中如有物梗塞，吞之不下，咯之不出为主症，舌白腻，脉弦滑（B错）。患者以精神恍惚，心神不宁，多疑易惊为主症，故诊断为郁证，精神恍惚，心神不宁，多疑易惊为心气耗伤，营血不足，心神失养所致，心神惑乱，不能自主，故悲忧善哭，喜怒无常，舌质淡，脉弦符合心神失养，情志异常的表现，故辨为心神失养证（C对）。郁证心脾两虚证以多思善疑，头晕神疲，心悸胆怯，失眠健忘，纳差，面色不华为主症，舌质淡，苔薄白，脉细（D错）。郁证心肾阴虚证以情绪不宁，心悸，健忘，失眠，多梦，五心烦热，盗汗，口咽干燥为主症，舌红少津，脉细数（E错）。